可用于治疗乙型肝炎病毒感染的药物是
A. 金刚烷胺
B. 阿昔洛韦
C. 更昔洛韦
D. 恩替卡韦
E. 奥司他韦

正确答案：D。恩替卡韦

解析：本题考查恩替卡韦。可用于治疗乙型肝炎病毒感染的药物是恩替卡韦（D对）。恩替卡韦适用于病毒复制活跃，血清丙氨酸氨基转移酶(ALT）持续升高或肝脏组织学显示有活动性病变的慢性成人乙型肝炎的治疗。金刚烷胺（A错）和奥司他韦（E错）为抗流感病毒药。阿昔洛韦（B错）和更昔洛韦（C错）为抗疱疹病毒药。